下列哪项不属于生殖健康的内涵
A. 性生活方面：人们能享有负责、满意和安全的性生活，不必担心染上传染性疾病和计划外妊娠
B. 生育功能方面：根据自己意愿决定是否生育、何时生育及生育间隔
C. 母婴安全方面：妊娠及分娩经过安全、妊娠结局成功，婴儿存活并健康成长
D. 节育方面：夫妇能对节育方法进行选择，并获取安全、有效、易接受的方法
E. 在生命各阶段没有疾病

正确答案：E。在生命各阶段没有疾病

解析：本题考查生殖健康的内涵。在生命所有阶段的生殖功能和过程中的身体、心理和社会适应的完好状态，而不仅仅是没有疾病和虚弱（E错，为本题正确答案）。其内涵主要强调：1.性生活方面：人们能享有负责、满意和安全的性生活，不必担心染上传染性疾病和计划外妊娠（A对）；2.生育功能方面：根据自己意愿决定是否生育、何时生育及生育间隔（B对）；3.母婴安全方面：妊娠及分娩经过安全、妊娠结局成功，婴儿存活并健康成长（C对）；4.节育方面：夫妇能对节育方法进行选择，并获取安全、有效、易接受的方法（D对）。